特异性杀伤肿瘤的细胞是
A. Tc（CTL）
B. NK
C. Mφ
D. LAK
E. 中性粒细胞

正确答案：A。Tc（CTL）

解析：CTL可特异性杀伤肿瘤细胞和病毒感染细胞，其杀伤机制有两种：一是分泌穿孔素、颗粒酶、颗粒溶解毒及淋巴毒素（LTa）直接杀伤靶细胞；二是通过Fas/FasL途径诱导靶细胞凋亡。掌握“T淋巴细胞”知识点。